评价人群疫苗接种效果最关键的指标是
A. 安全性
B. 种后反应率
C. 临床表现
D. 保护率

正确答案：D。保护率

解析：本题考查评价预防措施效果的指标。评价预防措施效果的指标包括：保护率（D对ABC错）和效果指数。